下列哪项能够在正态分布或近似正态分布中表示范围的估计值
A. 平均数
B. 构成比
C. 率
D. 可信区间
E. 标准差

正确答案：D。可信区间

解析：可信区间：在抽样调查中，虽有抽样误差存在，但只要是随机样本，其样本均数（或率）围绕总体均数（或率）呈正态分布或近似正态分布，故可以用样本均数（或率）和标准误对总体均数（或率）作出区间估计。掌握“口腔健康状况调查数据的整理和统计”知识点。